大剂量可引起听力损害和肾功能损害的药物是
A. 替考拉宁
B. 万古霉素
C. 克林霉素
D. 阿奇霉素
E. 利奈唑胺

正确答案：B。万古霉素

解析：本题考查万古霉素的不良反应。万古霉素（B对）不良反应主要表现为耳、肾毒性。替考拉宁（A错）不良反应主要为过敏反应。克林霉素（C错）不良反应主要为胃肠道反应。阿奇霉素（D错）主要不良反应为胃肠道反应。利奈唑胺（E错）不良反应主要为消化道反应、头痛、皮疹和血小板减少等。